《红楼梦》中的林黛玉，其动作稳定缓慢，观察事物细致人微，敏感多疑，孤独多虑，情感体验深刻且持久。根据巴甫洛夫高级神经活动类型学说，林黛玉的神经活动类型属于
A. 抑制型
B. 兴奋型
C. 活泼型
D. 安静型
E. 均衡型

正确答案：A。抑制型